下列各项，具有司眼睑开合作用的是
A. 督脉
B. 冲脉
C. 任脉
D. 跷脉
E. 带脉

正确答案：D。跷脉

解析：“跷”，有轻捷矫健之意，跷脉可主司下肢运动；同时阴跷脉和阳跷脉交会于目内眦，故又主司眼睑开合（C对）。